女性，60岁。口腔干燥、无泪、双眼异物感1年余。两侧腮腺区有反复肿胀史。检查发现：唇黏膜发红，舌表面光滑潮红呈“镜面舌”。口内大多数牙有龋坏，两侧腮腺弥漫性肿大，无压痛。挤压腺体导管口唾液溢出很少。为明确诊断而应做的辅助检查不包括
A. 施墨试验
B. 四碘四氯荧光素染色
C. 腮腺造影
D. 血脂检测
E. 唇腺活检

正确答案：D。血脂检测

解析：本题考查舍格伦综合征的诊断。根据该患者的主诉以及现病史，怀疑为患有舍格伦综合征，可通过一系列的辅助检查明确诊断。血脂反应出人体脂肪代谢的情况，对高血压、高脂血症、动脉粥样硬化等疾病有诊断意义，而血脂检测（D错，为本题的正确答案）对舍格伦综合征无诊断意义。施墨实验（A对）用于检测泪腺分泌功能，可作为辅助检查。四碘四氯荧光素染色（B对）是用1滴1%四碘四氯荧光素滴入眼结膜囊内，随即以生理盐水冲洗，可在暴露的睑裂角膜部位发现不同程度的荧光着色，是角膜上皮干燥状态的典型表现，也可作为辅助检查。腮腺造影（C对）为舍格伦主要诊断方法之一，主要表现为唾液腺末梢导管扩张，排空功能减退。唇腺活检（E对），若为舍格伦综合征，主要表现为腺小叶内淋巴、浆细胞浸润、腺实质萎缩、导管扩张。